青光眼、前列腺重度肥大患者应避免使用的饮片是
A. 华山参
B. 川楝子
C. 青风藤
D. 天仙藤
E. 五味子

正确答案：A。华山参

解析：本题考查的是现行《中国药典》收载毒性药材和饮片的用法用量。青光眼、前列腺重度肥大患者应避免使用的饮片是华山参（A对）。华山参有毒，用量0.1～0.2g。孕妇慎用。不宜多服；青光眼者禁服；前列腺重度肥大者慎用。川楝子（B错）有小毒，用量5～10g。外用适量，研末调涂。青风藤（C错）无毒。天仙藤（D错）含马兜铃酸，中毒可致肾小管坏死出现面部浮肿，渐至全身水肿、尿频尿急，甚至出现急、慢性肾功能衰竭及尿毒症而死亡。五味子（E错）：用时捣碎。